患者，男，62岁，因支气管哮喘使用沙美特罗-替卡松（舒利迭）治疗，近期因哮喘控制不佳就诊。药师要求该患者现场演示了准纳器的使用方法，错误的有
A. 推开滑动杆：握住准纳器，向外推开滑动杆直至发出“咔嗒”声，左右晃动准纳器
B. 吸入药物：先呼气，然后含住吸嘴，缓慢深吸后，将准纳器移开，立即恢复呼气
C. 打开装置：一手握住外壳，另一手的大拇指放在拇指柄上，向外推动拇指柄直至盖子完全打开
D. 关闭吸入器：使用干净纸巾擦拭吸嘴，将拇指放在拇指柄，向内推回原位
E. 漱口：吸入药物后，用清水漱口，漱口液勿吞咽

正确答案：A、B。推开滑动杆：握住准纳器，向外推开滑动杆直至发出“咔嗒”声，左右晃动准纳器；吸入药物：先呼气，然后含住吸嘴，缓慢深吸后，将准纳器移开，立即恢复呼气

解析：本题考查准纳器的使用方法。准纳器的使用方法：①用一手握住外壳，另一手的拇指放在拇指柄上，向外推动拇指柄直至完全打开（C对）（指示窗一面朝上）。②握住准纳器，使吸嘴对向自己；向外推开滑动杆直至发出“咔嗒”声（A错，为本题正确答案），表明准纳器已做好吸药准备；尽量呼气，但请勿将气体呼入准纳器中。③将吸嘴放入口中，从准纳器中深深地、平稳地吸入药物，切勿从鼻吸入；然后将准纳器从口中拿出，继续屏气约10秒（B错，为本题正确答案）；关闭准纳器时，将拇指放在拇指柄上，向内推回原位（D对），发出“咔嗒”声表示准纳器已关闭，滑动杆自动复位，准纳器又可用于下次吸药时使用。④缓慢呼气，最后用温水漱口（E对），保持口腔清洁。⑤如需吸入第二剂药物，须关上准纳器，1分钟后重复上述步骤。